对CD1分子描述错误的是
A. 提呈外源性脂类抗原
B. 是一类MHCⅠ类分子
C. 不能提呈自身脂类抗原
D. 有CD1a-e5个成员
E. 主要将脂类抗原提呈给NKT细胞

正确答案：C。不能提呈自身脂类抗原